慢性乙型肝炎最重要的治疗药物是
A. 扶正化瘀胶囊
B. 恩替卡韦
C. 甘草酸二胺
D. 利巴韦林
E. 胸腺肽

正确答案：B。恩替卡韦

解析：慢性乙肝最重要的治疗是抗病毒治疗目的是最大限度地长期抑制病毒复制，减少传染性；改善肝功能；减轻肝组织病变；改善生活质量；减少或延缓肝硬化、肝衰竭和HCC的发生，延长生存时间，对部分适合患者尽可能追求临床治愈，恩替卡韦（B对）是核苷类似物该类药物用于乙型肝炎的抗病毒治疗。扶正化瘀胶囊（A错）、甘草酸二胺（C错）、是改善和恢复肝功能的药物，并非慢性乙肝治疗最有效的药物。利巴韦林（D错）用于治疗慢性丙型肝炎。胸腺肽（E错）为免疫调节剂，能增强机体对乙肝病毒的抵抗，但也不是治疗慢性乙肝的最有效药物。